使用特殊染色（如硫代黄色T、刚果红等）证实牙源性钙化上皮瘤中淀粉样物质的沉积方式
A. 层状沉积
B. 波浪状沉积
C. 同心圆样沉积
D. 鱼鳞状沉积
E. 不规则沉积

正确答案：C。同心圆样沉积

解析：牙源性钙化上皮瘤内常见一种特征性圆形嗜酸性均质物质，分布于细胞之间，特殊染色（如硫代黄色T、刚果红等）证实这种物质为淀粉样物质。淀粉样物质内常发生钙化，钙化物呈同心圆沉积。掌握“牙源性钙化上皮、囊性瘤”知识点。